女，45岁。间断水肿3年，乏力3个月，查体：BP155/100mmHg，双下肢轻度凹陷性水肿，尿RBC20-30/HP，尿蛋白2.1g/d，血Hb78g/L，血Cr342umol/L，BUN16.1mmol/L，B超示双肾稍萎缩。为改善乏力症状，最有效的治疗措施是
A. 激素及免疫抑制剂治疗
B. 利尿治疗
C. 降压治疗
D. 注射促红细胞生成素及补充造血原料
E. 血液净化治疗

正确答案：D。注射促红细胞生成素及补充造血原料

解析：中年女性患者，间断水肿3年。检查：尿RBC20～30/HP（＞3/HP即为镜下血尿，提示有血尿），尿蛋白2.1g/d（正常为0～80mg/d，提示有大量蛋白尿），BP155/100mmHg（正常为90～130/60～90mmHg，提示血压升高），水肿、血尿、蛋白尿、高血压为慢性肾小球肾炎的基本临床表现。B超示双肾稍萎缩（提示为慢性病程），血Cr342umol/L（正常为88.4～176.8μmol/L，提示血肌酐升高），BUN16.1mmol/L（血尿素氮正常值3.5～7.7mmol/L，提示有氮质血症），血Hb78g/L（正常为110～150g/L，考虑为肾性贫血）。综合患者的病史、临床表现、实验室检查及影像学检查，考虑诊断为慢性肾衰竭。慢性肾衰竭患者，肾功能减退，肾间质细胞分泌促红细胞生成素减少，导致肾性贫血，产生乏力的症状。因此，为改善乏力症状，最有效的治疗措是注射促红细胞生成素及补充造血原料（D对）。利尿（B错）、降压（C错）和血液净化治疗（E错）也为慢性肾衰竭的治疗措施，但不能有效改善乏力症状。激素及免疫抑制剂治疗（A错）一般不用于慢性肾衰竭的患者。